不是鉴定金黄色葡萄球菌的依据为
A. 葡萄状排列的革兰阳性球菌
B. 产生金黄色色素
C. 血平板出现透明溶血环
D. 血浆凝固酶阳性
E. 发酵菊糖

正确答案：E。发酵菊糖